关于老年期的描述正确的是
A. 国际老年学会规定60～65岁为老年前期，65岁以后为老年期
B. 老年期妇女较易患各种身心疾病，如萎缩性阴道炎、子宫脱垂、妇科恶性肿瘤
C. 骨质疏松、脂代谢紊乱等
D. 应定期体格检查
E. 加强身体锻炼，防治老年期常见病、多发病

正确答案：A。国际老年学会规定60～65岁为老年前期，65岁以后为老年期

解析：本题考查老年期的相关内容。国际老年学会规定60～65岁为老年前期，65岁以后为老年期（A对BCDE错）。老年期是指卵巢功能进一步衰退、老化、生殖器萎缩。由于衰老，性激素减少，易致代谢紊乱，引起骨质疏松，易发生骨折。